女，20岁，突发下腹部疼痛伴恶心呕吐8小时。直肠-腹部诊：子宫前倾，正常大小，右侧附件区可触及一8cm×7cm×5cm囊实性包块，边界清楚，触痛明显。最可能的诊断是
A. 卵巢肿瘤蒂扭转
B. 急性阑尾炎
C. 卵巢黄体破损
D. 输卵管妊娠破裂
E. 浆膜下子宫肿瘤

正确答案：A。卵巢肿瘤蒂扭转

解析：患者为年轻女性，突发下腹部疼痛伴恶心呕吐8小时（蒂扭转的典型症状是体位改变后突然发生一侧下腹剧痛，常伴恶心、呕吐甚至休克）。直肠-腹部诊：子宫前倾，正常大小，右侧附件区可触及一8cm×7cm×5cm囊实性包块，边界清楚，触痛明显（双合诊检查可扪及压痛的肿块，以蒂部最明显），首先考虑为卵巢囊肿蒂扭转（A对）。急性阑尾炎（B错）常表现为转移性右下腹痛，右下腹的压痛和反跳痛。卵巢黄体破裂（P055）（C错）常发生于月经中后期，表现为不规则少量阴道流血，妇检有一侧附件压痛，无肿块触及。输卵管妊娠破裂（P053）（D错）有6～8周停经史，表现为突感一侧下腹部剧烈疼痛，并伴有恶心、呕吐，常有不规则少量阴道流血。浆膜下子宫肌瘤（P312）（E错）发生蒂扭转时可有急性腹痛，但子宫肌瘤常见于30～50岁妇女，20岁以下少见。